女，72岁，胃癌根治术后第6天，出现上腹剧烈疼痛，逐渐加重，伴恶心，呕吐，腹胀，腹腔引流管引出咖啡色浑浊液体。查体：腹膜刺激征（+）。腹部B超提示腹腔积液。最可能的诊断是
A. 肠系膜血管缺血性疾病
B. 急性胰腺炎
C. 急性胆囊炎
D. 急性梗阻性化脓性胆管炎
E. 吻合口瘘

正确答案：E。吻合口瘘

解析：老年患者，胃癌根治术后第6天，出现上腹剧烈疼痛，逐渐加重，伴恶心，呕吐，腹胀，腹腔引流管引出咖啡色浑浊液体，查体：腹膜刺激征（+），腹部B超提示腹腔积液，诊断为吻合口瘘（E对）继发急性腹膜炎，胃癌根治术吻合口瘘主要由血供不足所导致，一般出现术后1周左右，导致胃内容物进入腹腔导致急性腹膜炎。肠系膜缺血性疾病呈现为症状严重、体征轻微的症状与体征不相称的特点（A错）。急性胰腺炎主要见于有胆道疾病等基础疾病并暴饮暴食的患者（B错）。急性胆囊炎表现为饱餐、进食油腻食物后出现右上腹疼痛，查体：Murphy征阳性（C错）。急性梗阻性化脓性胆管炎，也称急性重症胆管炎表现为Reynolds五联征（右上腹痛、黄疸、高热、休克、神经中枢系统受抑制）（D错）。